血脉的正常运行依赖于
A. 肝主疏泄
B. 肝藏血
C. 肺朝百脉
D. 心主血脉
E. 脾统血

正确答案：A、B、C、D、E。肝主疏泄；肝藏血；肺朝百脉；心主血脉；脾统血

解析：本题考查的是血的运行。血脉的正常运行依赖于肝主疏泄（A对）、肝藏血（B对）、肺朝百脉（C对）、心主血脉（D对）与脾统血（E对）。血的运行：血液循行于脉管之中，流布于全身，运行不息，以供给机体各脏腑组织器官的营养需要。血液的正常循行，依靠气的推动与固摄作用的协调平衡。心主血脉，心气的推动，是血液循行的基本动力。肺朝百脉，即全身的血液，汇聚于肺，依赖肺气作用合成宗气，助心行血，分布全身。肝主疏泄，调畅气机，气行则血行。而脾主统血和肝之藏血功能，依赖气的固摄作用，使血液运行于脉中而不逸于脉外。